固定桥承受（牙合）力时，（牙合）力传导到基牙上是通过
A. 固位体
B. 固定连接体
C. 活动连接体
D. 桥体
E. 桥体龈端的黏膜

正确答案：A。固位体

解析：固定桥承受（牙合）力的时候最终承担（牙合）力的基牙，固位体和基牙直接接触的，所以最终（牙合）力都要通过固位体传到基牙上。掌握“固定桥的设计”知识点。